休克微循环缺血缺氧期，心脑灌流与正常时相比：
A. 心脑灌流量明显增加；
B. 心脑灌流量明显减少；
C. 心脑灌流量先增加后减少；
D. 心脑灌流量可无明显改变；
E. 心灌流量减少，脑灌流量无明显改变。

正确答案：D。心脑灌流量可无明显改变；

解析：休克微循环缺血缺氧期心脑灌流与正常时相比，心脑灌流量可无明显改变（D对ABCE错），因为皮肤、骨骼肌以及内脏血管的 α受体分布密度高，对儿茶酚胺的敏感性较高，收缩明显。 而冠状动脉则以β受体为主，激活时引起冠状动脉舒张；脑动脉则主要受局部扩血管物质影响，只要血压不低于60mmHg, 脑血管可通过自身调节维持脑血流量的相对正常。 因此，在微循环缺血性缺氧期，心、脑微血管灌流量能稳定在一定水平。这种不同器官微循环反应的差异，导致了血液的重新分布，保证了心、脑重要生命器官的血液供应。